肺癌高发在
A. 城市居民中
B. 乡村居民中
C. 燃柴农户的居民中
D. 燃煤农户的居民中
E. 空气中苯并（a）芘浓度较高地区的居民中

正确答案：E。空气中苯并（a）芘浓度较高地区的居民中

解析：本题考查肺癌的相关内容。污染大气的致癌物主要是多环芳烃类（PAH）化合物，以苯并（a）芘（BaP）含量最多，具有强致癌性。因此，肺癌高发在空气中苯并（a）芘浓度较高地区的居民中（E对ABCD错）。